女，45岁，双手近端指间关节，双腕和双踝肿痛5个月。查体：双手近端指间关节梭形肿胀；压痛（+），实验室检查：ESR45mm/h，RF阳性，抗环瓜氨酸肽抗体阳性。最可能的诊断是
A. 骨关节炎
B. 类风湿关节炎
C. 痛风关节炎
D. 脊柱关节炎
E. 系统性红斑狼疮

正确答案：B。类风湿关节炎

解析：中年女性患者（类风湿关节炎好发人群），双手近端指间关节，双腕和双踝肿痛5个月。查体：双手近端指间关节梭形肿胀，压痛（+）（类风湿关节炎常见表现），ESR45mm/h（血沉正常值男性0-10mm/h），RF阳性，抗环瓜氨酸肽抗体（CCP抗体）阳性（对于类风湿关节炎诊断特异性高），根据患者临床表现、查体及实验室检查，可诊断为类风湿性关节炎（B对）。骨关节炎（A错）多见于中老年人，主要累及远端指关节，RF及自身抗体均为阴性。痛风性关节炎（C错）是嘌呤代谢障碍、血尿酸增高所致反复发作的关节炎症，好发于40岁以上男性，女性仅约占5％，多见于第一跖趾关节，也可发生于其他较大关节，尤其是踝部与足部关节。脊柱关节炎（D错）主要见于青年男性，最典型及常见表现为下腰背部疼痛，抗CCP抗体阴性。系统性红斑狼疮（E错）常出现在指、腕、膝关节，伴红肿者少见，且有关节外的系统症状如蝶形红斑等。